在体内不经细胞色素P450酶代谢的药物是
A. 氟伐他汀
B. 普伐他汀
C. 阿托伐他汀
D. 瑞舒伐他汀
E. 洛伐他汀

正确答案：B。普伐他汀

解析：本题考查药物的相互作用。普伐他汀（B对）在体内不经细胞色素P450酶代谢。经体内和体外实验证实，普伐他汀不经CYP3A4代谢，因此不会与其它由细胞色素P450系统代谢的药物（如苯妥英钠、奎尼丁等）产生明显的相互作用，也不会与CYP3A4抑制剂（如地尔硫䓬、伊曲康唑、酮康唑、红霉素等）产生明显的相互作用。体外和体内研究的资料都显示，瑞舒伐他汀（D错）既非细胞色素P450同工酶的抑制剂，也不是酶诱导剂。另外，瑞舒伐他汀是这些酶的弱底物。瑞舒伐他汀与氟康唑（CYP2C9和CYP3A4的一种抑制剂）或酮康唑（CYP2A6和CYP3A4的一种抑制剂）之间不存在具有临床相关性的相互作用。与伊曲康唑（CYP3A4的一种抑制剂）合用，瑞舒伐他汀的AUC增加28%，这种增加不被认为有临床意义。因此，瑞舒伐他汀不存在由细胞色素P450介导的代谢所致的药物相互作用。氟伐他汀（A错）、阿托伐他汀（C错）、洛伐他汀（E错）主要被肝药酶CYP3A4代谢，它们可与CYP2A4抑制剂发生相互作用，因而在体内是经细胞色素P450酶代谢的。